人类社会化的主要手段是
A. 教育
B. 宗教
C. 信仰
D. 风俗
E. 法律

正确答案：A。教育